有关皮质脊髓束的错误描述是
A. 起于中央前回中、上部和中央旁小叶的前部
B. 经内囊后肢下行
C. 大部分纤维在锥体下端左右交叉
D. 皮质脊髓侧束一般只达中胸节
E. 锥体交叉平面以上损伤引起对侧肢体痉挛性瘫痪

正确答案：D。皮质脊髓侧束一般只达中胸节

解析：皮质脊髓束起于中央前回中、上部和中央旁小叶的前部（A对），上述部位的锥体细胞发出轴突形成皮质脊髓束后，经内囊后肢（B对）的前部、大脑脚底中3/5的外侧部和脑桥基底部下行至延髓锥体。皮质脊髓束中的大部分纤维在锥体下端左右交叉（C对），交叉后的纤维继续在对侧脊髓侧索内下行，称皮质脊髓侧束，沿途发出侧支，逐节终止于前角细胞（可达骶节）（D错，为本题正确答案），主要支配四肢肌。因皮质脊髓束属上运动神经元发出的纤维，故锥体交叉平面以上损伤引起对侧肢体痉挛性瘫痪（E对）。